蛋白质一级结构被破坏时出现
A. 构象改变
B. 亚基聚合
C. 肽键断裂
D. 二硫键形成
E. 蛋白质聚集

正确答案：C。肽键断裂